执业药师在审方中发现有中成药不合理配伍，下列各组配伍中，属证候禁忌的是
A. 二陈丸与平胃丸
B. 归脾丸与人参养荣丸
C. 金匮肾气丸与麦味地黄丸
D. 附子理中丸与黄连上清丸
E. 生脉饮与六味地黄丸

正确答案：D。附子理中丸与黄连上清丸

解析：本题考查的是不同功效药物联用的辨证论治和禁忌。执业药师在审方中发现有中成药不合理配伍，下列各组配伍中，属证候禁忌的是附子理中丸与黄连上清丸（D对）。不同功效药物联用的辨证论治和禁忌：如附子理中丸与牛黄解毒片联用，附子理中丸系温中散寒之剂，适用于脾胃虚寒所致的胃脘痛、呕吐、腹泻等；而牛黄解毒片性质寒凉，为清热解毒泻火之剂，适用于火热毒邪炽盛于内而上扰清窍者，可见不加分析地盲目将两者合用是不适宜的。再如，盲目将附子理中丸与黄连上清丸、金匮肾气丸与牛黄解毒片等合用，均属不注意证候的不合理用药。二陈丸与平胃丸（A错）属于功效不同的中成药配伍同用。功效不同的中成药配伍同用，一药为主，一药为辅，辅药能够提高主药功效。例如以二陈丸燥湿化痰为主方治疗湿痰咳嗽，而脾为生痰之源，辅以平胃散同用，燥湿健脾，可明显增强二陈丸燥湿化痰之功。又如以乌鸡白凤丸为主药治疗妇女气血不足、月经失调，辅以香砂六君丸，以开气血生化之源，增强主药的养血调经之功。归脾丸与人参养荣丸（B错）属于配伍应用，两种功效相似的中成药同用治疗一种病证，以起到增强疗效的协同作用。归脾丸与人参养荣丸同用，可明显增强补益心脾、益气养血、安神止痉的功效，治疗心悸失眠、眩晕健忘。金匮肾气丸与麦味地黄丸（C错）属于中成药配伍应用，其中一种药物能够明显抑制或消除另一种中成药的偏性或副作用。用金匮肾气丸治疗肾虚作喘，但若久治不愈，阳损及阴，兼见咽干烦躁者，又当配麦味地黄丸、生脉散或参蛤散同用，以平调阴阳、纳气平喘，且防止金匮肾气丸燥烈伤阴，降低副作用。生脉饮与六味地黄丸（E错）同用的效果，2022年考试指南未明确说明。